在腮腺浅叶前缘由上到下依次为
A. 面神经颧支、面神经上颊支、腮腺导管、面神经下颊支
B. 面神经颧支、面神经上颊支、腮腺导管、面神经下颊支、下颌缘支
C. 面动脉、面横动脉、面神经颧支、腮腺导管
D. 面横动脉、面神经颧支、面神经上颊支、腮腺导管、面神经下颊支、面神经下颌缘支
E. 面神经颧支、面横动脉、面神经上颊支、腮腺导管、面神经下颊支

正确答案：D。面横动脉、面神经颧支、面神经上颊支、腮腺导管、面神经下颊支、面神经下颌缘支

解析：本题考查腮腺的毗邻。在腮腺浅叶前缘由上到下依次为面横动脉、面神经颧支、面神经上颊支、腮腺导管、面神经下颊支、面神经下颌缘支（D对）。腮腺深浅叶之分，是根据面神经总干和其分支经过的平面来分，位于面神经及其分支浅面的腮腺组织为浅叶，深面的腮腺组织为深叶。在腮腺浅叶前缘神经血管排列由上到下依次为：面横动脉、面神经颧支、面神经上颊支、腮腺管、面神经下颊支及下颌缘支。